女，48岁。近一个月感口渴饮水量增至每天2000毫升。身高156厘米、体重71公斤。空腹血糖180mg/dl（10.0mmol/L），餐后血糖252mg/dl（14.0mmol/L）。系初次发现血糖高，过去无糖尿病史。给患者的治疗建议是
A. 饮食及运动治疗
B. 双胍类降血糖药
C. 磺脲类降血糖药
D. α-葡萄糖苷酶抑制剂
E. 胰岛素

正确答案：A。饮食及运动治疗

解析：中年女性患者，出现口渴、多饮（糖尿病典型症状），空腹血糖＞7.0 mmol/L，餐后血糖＞11.1 mmol/L，体重指数为29.2（体重指数=体重（kg）÷身高²（m²），正常值为18.5～24.9，＞29则提示肥胖），既往无糖尿病史，考虑诊断为2型糖尿病。本例为初诊糖尿病，患者体型肥胖，血糖未明显升高，可首先采用生活方式干预即饮食及运动治疗（A对），患者体重适度减轻，一般血糖也会随之下降。当饮食及运动治疗效果不佳时再采取药物治疗，双胍类降血糖药（B错）、磺脲类降血糖药（C错）、α-葡萄糖苷酶抑制剂（D错）、胰岛素（E错）均为药物治疗，目前不适用于本患者。